在不受性别、年龄的影响下，（牙合）力最大的牙是
A. 第一磨牙
B. 第二磨牙
C. 第三磨牙
D. 中切牙
E. 尖牙

正确答案：A。第一磨牙

解析：（牙合）力大小顺序为：第一磨牙＞第二磨牙＞第三磨牙＞第二前磨牙＞第一前磨牙＞尖牙＞中切牙＞侧切牙，其中第一、第二磨牙差别有时不明显。上述（牙合）力次序不受性别、年龄的影响。掌握“咀嚼过程、类型，咀嚼周期及生物力”知识点。